患者男性，40岁，口底多间隙感染，肿胀明显，可及捻发音及波动感，主诉呼吸困难，下列处理正确的是
A. 加大抗生素剂量
B. 局部热敷
C. 穿刺抽脓
D. 广泛切开引流
E. 局限性切开引流后加压包扎

正确答案：D。广泛切开引流

解析：本题考查口底蜂窝织炎的治疗。肿胀范围广泛，已有呼吸困难，应作广泛性切开引流（D对），使口底各个间隙的坏死组织及脓液能得到充分引流。口底蜂窝织炎，抗菌药物治疗是早期积极治疗措施（A错）。局部热敷可促进血肿吸收，可能导致炎症扩散（B错）。炎症肿胀明显，可及捻发音及波动感，能够确定脓肿位置，不需要穿刺抽脓（C错）。局限性切开引流后加压包扎，不能充分引流，可能有窒息危险（E错）。